“孤阴不生，独阳不长”的理论根据是
A. 阴阳一体观
B. 阴阳互根
C. 阴阳消长
D. 阴阳转化
E. 阴阳平衡

正确答案：B。阴阳互根

解析：阴阳一体观：①阴阳虽然对立相反，但在一个统一体中协调共济。②统一体中阴阳双方相互依赖而存在，任何一方都不能脱离另一方而单独存在。这就是阴阳的相互依存。③统一体中的阴阳双方，每一方都涵有另一方，阴中含阳，阳中寓阴，所谓阴阳互藏（A错）。阴阳互根的意义，在于阴阳始终处于统一体之中，每一方都以对方的存在作为自身存在的前提和条件，任何一方都不能脱离对方而单独存在（B对）。阴阳消长，指阴阳双方不是静止不变的，而是处于不断的消减和增加的运动变化之中。消，减少、减退；长，增加、增长（C错）。阴阳转化，指事物的阴阳属性，在一定条件下可以向其相反的方向转化，即属阳的事物可以转化为属阴的事物，属阴的事物可以转化为属阳的事物（D错）。阴阳平衡是生命活力的根本。阴阳平衡就是阴阳双方的消长转化保持协调，既不过分也不偏衰，呈现着一种协调的状态。阴阳平衡则人健康、有神；阴阳失衡人就会患病、早衰，甚至死亡（E错）。